新生儿心率低于多少时需采用心脏按压术
A. 30次/分
B. 40次/分
C. 50次/分
D. 60次/分
E. 70次/分

正确答案：D。60次/分

解析：新生儿心率低于60次/钟，出生新生儿低于100次/分均需施行心脏按压（D对）。30次/分（A错）为年长儿心脏按压的标准。40次/分（B错）、50次/分（C错）、70次/分（E错）均不是新生儿需采用心脏按压术时心率的标准。